左心衰竭最早出现的症状是
A. 劳力性呼吸困难
B. 夜间阵发性呼吸困难
C. 端坐呼吸
D. 咯血
E. 少尿

正确答案：A。劳力性呼吸困难

解析：左心衰时，心室肌收缩-舒张功能失代偿，左心房内压升高，使肺静脉及肺毛细血管淤血，表现为不同程度的呼吸困难。其中劳力性呼吸困难是左心衰竭最早出现的症状（A对），因运动使回心血量增加，左心房压力升高，加重肺淤血引起呼吸困难。肺淤血程度与心衰严重程度成正相关，故引起呼吸困难的运动量随心衰程度加重而减少。随心衰程度的加重，呼吸困难依次表现为劳力性呼吸困难，端坐呼吸（C错），夜间阵发性呼吸困难（B错）和急性肺水肿。长期慢性肺淤血肺静脉压力升高，导致肺循环和支气管血液循环之间在支气管黏膜下形成侧支，此种血管一旦破裂可引起咯血。严重的左心衰竭时全身血液重新分配，肾血流量减少，以满足重要器官血液供应。咯血（D错）和少尿（E错）症状出现较晚。